患者，男，50岁。咳嗽、咳痰3年，每年发病持续4个月。肺底可听到散在干啰音,X线检查无异常。其诊断是
A. 慢性支气管炎
B. 肺结核
C. 支气管哮喘
D. 肺炎球菌肺炎
E. 肺癌

正确答案：A。慢性支气管炎

解析：患者中年男性。咳嗽、咳痰3年，每年发病持续4个月（慢性支气管炎常见的临床表现）。肺底可听到散在干啰音,X线检查无异常（初步排除其他肺部疾病）。考虑其诊断是慢性支气管炎（A对）。肺结核（P64）（B错）多表现为长期午后潮热，乏力、盗汗、食欲减退和体重减轻等症状。支气管哮喘（P30）（C错）典型症状为发作性伴有哮鸣音的呼气性呼吸困难。肺炎球菌肺炎（P44）（D错）起病急，多有寒战、高热、咳铁锈色痰等症状。肺癌（P78）（E错）常发生于有长期大量吸烟史的老年人，多伴有咳嗽、咯血、气短、发热和体重下降等症状。